侧向咬合运动,工作侧髁突向外侧运动幅度最大约
A. 0.5mm
B. 1mm
C. 2mm
D. 3mm
E. 1.5mm

正确答案：D。3mm

解析：本题考查侧向咬合运动的工作侧。侧向咬合运动,工作侧髁突向外侧运动幅度最大约3mm（D对）。侧移的量一般不超过3mm，多在2mm以内。（1）工作侧髁突运动范围：以髁突W为顶点，向外侧运动约3mm的60°圆锥体，在此范围内，髁突可作任何方向的运动。此圆锥在前后方向是不对称的，略向后倾斜。对个体而言，工作侧髁突的运动在上述范围内有一定差异，具有个体特征。（2）非工作侧髁突侧移，大部分发生在从正中关系位向前方移动的最初4mm一段过程之中，分为迅即侧移、早期侧移、散布侧移和渐进侧移四种类型。